两代生殖毒性试验，从亲代开始染毒，观察至
A. 子2代出生
B. 子2代断乳
C. 子1代出生
D. 子1代断乳
E. 子1代染毒结束

正确答案：B。子2代断乳